对根尖孔尚未形成的年轻恒牙，应注意
A. 保存活髓
B. 保存牙槽骨
C. 使用根尖诱导成形术
D. 拔除
E. 保留牙齿

正确答案：A。保存活髓

解析：对牙髓病变还处于早期阶段的恒牙和根尖孔尚未形成的年轻恒牙，应注意保存活髓，维护牙髓的功能。掌握“牙髓根尖周病的治疗总论”知识点。